关于前列腺增生的临床表现错误的是
A. 尿频、夜尿增多为早期症状
B. 尿急或急迫性尿失禁
C. 对肾功能无影响
D. 尿不尽、残余尿增多
E. 是老年男性常见的血尿原因之一

正确答案：C。对肾功能无影响